脑组织在正常情况下主要利用葡萄糖供能，只有在下述某种情况下脑组织主要利用酮体
A. 剧烈运动
B. 空腹
C. 短期饥饿
D. 长期饥饿
E. 轻型糖尿病

正确答案：D。长期饥饿